疾病预防控制机构、接种单位、疫苗生产企业发现假劣或者质量可疑的疫苗，应当立即停止接种、分发、供应、销售，并立即向所在地的县级人民政府卫生行政部门和负责药品监督管理的部门报告。接到报告的相关部门应采取有效防控措施。下列后续措施中，正确的有
A. 接到报告的负责药品监督管理的部门，对脱离冷链和来源不明的疫苗，应立即责令召回的
B. 接到报告的负责药品监督管理的部门，应当对假劣或者质量可疑的疫苗依法采取查封、扣押等措施
C. 接到报告的卫生行政部门，应当向上级卫生行政部门报告
D. 接到报告的卫生行政部门，应当立即组织疾病预防控制机构和接种单位采取必要的应急处置措施

正确答案：B、C、D。接到报告的负责药品监督管理的部门，应当对假劣或者质量可疑的疫苗依法采取查封、扣押等措施；接到报告的卫生行政部门，应当向上级卫生行政部门报告；接到报告的卫生行政部门，应当立即组织疾病预防控制机构和接种单位采取必要的应急处置措施

解析：本题考查《中华人民共和国疫苗管理法》。疾病预防控制机构、接种单位、疫苗生产企业发现假劣或者质量可疑的疫苗，应当立即停止接种、分发、供应、销售，并立即向所在地的县级人民政府卫生行政部门和负责药品监督管理的部门报告。接到报告的相关部门应采取有效防控措施。下列后续措施中，正确的有接到报告的负责药品监督管理的部门，应当对假劣或者质量可疑的疫苗依法采取查封、扣押等措施（B对）；接到报告的卫生行政部门，应当向上级卫生行政部门报告（C对）；接到报告的卫生行政部门，应当立即组织疾病预防控制机构和接种单位采取必要的应急处置措施（D对）。《中华人民共和国疫苗管理法》第九章监督管理第七十三条：疫苗存在或者疑似存在质量问题的，疫苗上市许可持有人、疾病预防控制机构、接种单位应当立即停止销售、配送、使用，必要时立即停止生产，按照规定向县级以上人民政府药品监督管理部门、卫生健康主管部门报告。卫生健康主管部门应当立即组织疾病预防控制机构和接种单位采取必要的应急处置措施，同时向上级人民政府卫生健康主管部门报告。药品监督管理部门应当依法采取查封、扣押等措施。对已经销售的疫苗，疫苗上市许可持有人应当及时通知相关疾病预防控制机构、疫苗配送单位、接种单位，按照规定召回（A错），如实记录召回和通知情况，疾病预防控制机构、疫苗配送单位、接种单位应当予以配合。给予重奖。未依照前款规定停止生产、销售、配送、使用或者召回疫苗的，县级以上人民政府药品监督管理部门、卫生健康主管部门应当按照各自职责责令停止生产、销售、配送、使用或者召回疫苗。疫苗上市许可持有人、疾病预防控制机构、接种单位发现存在或者疑似存在质量问题的疫苗，不得瞒报、谎报、缓报、漏报，不得隐匿、伪造、毁灭有关证据。